下列哪种氨基酸是半必需氨基酸
A. 苏氨酸
B. 脯氨酸
C. 酪氨酸
D. 赖氨酸
E. 亮氨酸

正确答案：C。酪氨酸